用于牙周治疗的氯己定（洗必泰）溶液具有的特点是
A. 易使细菌产生抗药性
B. 可吸附于牙表面，缓慢释放
C. 窄谱抗菌剂
D. 每日漱口一次
E. 长期含漱后牙面洁白

正确答案：B。可吸附于牙表面，缓慢释放

解析：本题考查用于牙周治疗的氯己定溶液具有的特点。用于牙周治疗的氯己定（洗必泰）溶液具有的特点是可吸附于牙表面，缓慢释放（B对）。氯己定溶液长期使用安全，不易使细菌产生抗药性（A错）；可以吸附在牙面和口腔黏膜上皮，缓慢释放；属于广谱抗生素（C错）类，对革兰阳性菌及革兰阴性菌和真菌都有较强的抗菌作用，是目前已知效果最确切的抗菌斑药物；用于漱口时，每天两次（D错）；可以有效控制菌斑，长期使用可使牙面着色，但不能使牙面洁白（E错）。